治血热妄行所致的出血病证，应选用
A. 茜草
B. 艾叶
C. 地榆
D. 大蓟
E. 白茅根

正确答案：A、C、D、E。茜草；地榆；大蓟；白茅根

解析：本题考查的是茜草、地榆、大蓟与白茅根的主治病证。治血热妄行所致的出血病证，应选用茜草（A对）、地榆（C对）、大蓟（D对）或白茅根（E对）。茜草：【性能特点】本品苦泄散，寒清凉，入肝经。炒炭行中有止，善化瘀、凉血而止血；生用则专于凉散，善活血凉血而化瘀通经。有止血而不留瘀、活血而不动血之长，凡出血无论属血瘀夹热还是血热夹瘀者皆宜，尤以血热血瘀兼出血者用之最佳。【主治病证】（1）吐血，衄血，崩漏，尿血，便血等。（2）闭经，痛经，跌打肿痛，痹证关节痛。地榆：【主治病证】（1）血热之咳血、衄血、吐血、尿血、便血、痔血、崩漏及月经过多。（2）烫伤，湿疹，皮肤溃烂，疮疡肿毒。大蓟：【主治病证】（1）血热之咳血、衄血、吐血、崩漏、尿血，外伤出血。（2）热毒痈肿。白茅根：【主治病证】（1）血热之衄血、咳血、吐血及尿血。（2）热病烦渴，胃热呕哕，肺热咳嗽。（3）血淋，热淋，小便不利，水肿，湿热黄疸。艾叶（B错）：【主治病证】（1）虚寒性崩漏下血、胎漏。（2）经寒痛经、月经不调，带下清稀，宫冷不孕。（3）脘腹冷痛。（4）湿疹瘙痒（外用）。此外，可用于温灸。